艾森克人格问卷的分量表中，代表情绪稳定性特征的是
A. E量表
B. N量表
C. P量表
D. L量表
E. 以上都不是

正确答案：B。N量表

解析：艾森克人格问卷（EPQ）的四个分量表分别为：①E量表（内-外向量表），主要测量人格的外显或内隐倾向。②N量表（神经质量表）测情绪稳定性。高分者对外界的刺激敏感，容易产生焦虑、紧张等情绪反应。③P量表（精神质量表），测潜在的精神特质或称倔强。艾森克认为精神特质在每个人身上都存在，只不过程度不同而已。分数高者表现为比较孤独、不合群，具有一定的攻击倾向，社会适应水平较低。④L量表（掩饰量表），也称“测谎”，为效度量表。测受试者的掩饰或防御倾向，分数过高则表示测量的可靠性较差，影响结果评定。掌握“常用的心理测验及临床评定测量表”知识点。